女，28岁。平时月经规则，现停经60天，阴道流血10天。妇科检查子宫如妊娠3个月大，软，无压痛，双侧附件区均扪及5cm囊性包块，壁薄，活动好，无压痛。血HCG增高明显。为确诊应首先进行的检查是
A. 血清CA125测定
B. 盆腔B超检查
C. 盆腔CT
D. 盆腔MR
E. 腹部X线摄片

正确答案：B。盆腔B超检查

解析：患者为年轻女性，平时月经规则，现停经60天（疑为早孕），阴道流血10天（葡萄胎患者一般在停经8～12周左右开始不规则阴道流血，量多少不定）。妇科检查子宫如妊娠3个月大，软（因葡萄胎迅速增长及宫腔内出血，约半数以上患者的子宫大于停经月份，质地变软），无压痛，双侧附件区均扪及5cm囊性包块，壁薄，活动好，无压痛（大量hCG刺激卵巢卵泡内膜细胞发生黄素化形成卵巢黄素化囊肿。常为双侧，大小不等，活动度好，囊壁薄）。血hCG增高明显（葡萄胎患者hCG水平异常升高），最可能的诊断是葡萄胎。为确诊应首先进行的检查是B型超声（B对），其是诊断葡萄胎的一项可靠和敏感的辅助检查且具有无创、无辐射的优点：完全性葡萄胎的典型超声图像为子宫大于相应孕周，无妊娠囊或胎心搏动，宫腔内充满不均质密集状或短条状回声，呈落雪状，水泡较大时则呈蜂窝状；部分性葡萄胎可在胎盘部位出现由局灶性水泡状胎块引起的超声图像改变，有时可见胎儿或羊膜囊，胎儿通常畸形。B超检查后，可行X线胸片或胸部CT检查，观察是否恶变有肺转移，与妊娠滋养细胞肿瘤相鉴别，进一步明确诊断，但盆腔CT（C错）、腹部X线摄片（E错）对确诊葡萄胎及观察其是否恶变发生转移意义不大；若X线胸片或胸部CT阳性者，应查脑、肝CT或MRI，而不是盆腔MRI（D错）。血清CA125测定（P324）（A错）主要用于卵巢上皮性肿瘤的辅助检查。